慢性肺脓肿较急性肺脓肿更为常见的体征是
A. 肺部闻及支气管呼吸音
B. 肺部叩诊呈鼓音
C. 肺部呼吸音减弱
D. 肺部闻及湿啰音
E. 杵状指

正确答案：E。杵状指

解析：肺脓肿的肺部体征与肺脓肿的大小和部位有关。初起时肺部可无阳性体征，或患侧可闻及湿啰音，病变继续发展，可出现肺实变体征，可闻及支气管呼吸音，肺脓腔增大时，可出现空翁音，病变累及胸膜时可闻及胸膜摩擦音或出现胸腔积液体征，血源性肺脓肿大多无阳性体征，慢性肺脓肿常有杵状指（E对）。肺部闻及支气管呼吸音（A错）常见于支气管肺炎、肺结核、大叶性肺炎等。肺部叩诊呈鼓音（B错）常见于气胸。肺部呼吸音减弱（C错）常见于肺气肿、胸腔积液。肺部闻及湿啰音（D错）常见于肺水肿、肺炎、急性左心衰。